根据不同情况，有关单位可以分别采取以下方式运输病原微生物菌（毒）种或者样本，但不包括
A. 公路
B. 水路
C. 民用的航空
D. 铁路
E. 公共汽车

正确答案：E。公共汽车